甘草中所含的三萜皂苷的结构类型是
A. 羊毛甾烷型
B. 达玛烷型
C. 羽扇豆烷型
D. 四环三萜
E. 齐墩果烷型

正确答案：E。齐墩果烷型

解析：本题考查的是五环三萜的结构类型。甘草中所含的三萜皂苷的结构类型是齐墩果烷型（E对）。甘草所含的三萜皂苷以甘草皂苷含量最高。甘草皂苷又称甘草酸，为甘草中的甜味成分。五环三萜主要类型包括齐墩果烷型、乌苏烷型和羽扇豆烷型等。（1）齐墩果烷型又称β-香树脂烷型，此类三萜皂苷元以齐墩果酸最为多见。（2）乌苏烷型又称α-香树脂烷型或熊果烷型，此类三萜大多是乌苏酸的衍生物。（3）羽扇豆烷型（C错）的结构特点是E环为五元碳环，如羽扇豆种子中存在的羽扇豆醇，酸枣仁中分得的白桦醇和白桦酸等。三萜的种类很多，但以皂苷形式存在的三萜类型并不多，较为常见的有羊毛甾烷型（A错）、达玛烷型（B错）、齐墩果烷型、乌苏烷型和羽扇豆烷型，其中前两种属于四环三萜（D错），后三种则属于五环三萜。